使肩关节关节旋内的肌是
A. 冈上肌
B. 冈下肌
C. 肩胛下肌
D. 小圆肌
E. 胸小肌

正确答案：C。肩胛下肌

解析：冈上肌（A错）使肩关节外展，冈下肌（B错）和小圆肌（D错）使肩关节旋外。肩胛下肌（C对）使肩关节内收、旋内。胸小肌（E错）拉肩胛骨向前下方。